某人群随着对环境有害物质暴露的增加，所引起的具有某种生物效应的人数随着变化的现象，为
A. 时间-效应关系
B. 剂量-效应关系
C. 时间-反应关系
D. 剂量-反应关系
E. 剂量-发病关系

正确答案：D。剂量-反应关系

解析：某人群随着对环境有害物质暴露的增加，所引起的具有某种生物效应的人数随着变化的现象，为剂量-反应关系（D对）。题干中“有害物质暴露增加”为剂量变化，“生物效应的人数变化”为反应变化。剂量-效应关系（B错）它表示化学物的摄入量与生物个体或群体中发生某种量效应强度之间的关系。注意区分效应程度（生物效应的强度变化）与反应程度（生物效应的频率变化）。题目中没有出现时间相关的条件，因此不应考虑时间-效应关系（A错）、时间-反应关系（C错）。没有剂量-发病关系（E错）